病例对照研究中的匹配是指
A. 病例组的样本数等于对照组的样本数
B. 病例组和对照组的某些特征或变量一致
C. 病例组和对照组的研究因素一致
D. 病例组和对照组的所有特征或变量一致
E. 病例组和对照组的研究因素的数量完全一致

正确答案：B。病例组和对照组的某些特征或变量一致

解析：本题考查匹配。匹配是要求对照在某些特征或因素上与病例保持一致（B对ACDE错），保证对照与病例具有可比性，以便对两组进行比较时排除匹配因素的干扰。